回力卡环与反回力卡均为铸造卡环将起
A. 应力集中的作用
B. 应力中断的作用
C. 固位支持的作用
D. 固位稳定的作用
E. 稳定支持的作用

正确答案：B。应力中断的作用

解析：回力卡环：常用于后牙游离端缺失，基牙为前磨牙或尖牙，牙冠较短或为锥形牙。卡环臂尖端位于基牙的唇（颊）面倒凹区，绕过基牙的远中面与支托相连接，再转向舌面的非倒凹区，在基牙近中舌侧通过连接体与腭（舌）杆相连：卡环臂尖端位于基牙舌面倒凹区时，与远中支托相连，转向近中颊侧通过连接体与基托相连者称反回力卡。两者均为铸造卡环，由于远中支托不与基托相连接，（牙合）力则通过人工牙和基托传到黏膜和颌骨上，减轻基牙的负荷，起应力中断的作用。掌握“局部义齿固位体”知识点。